聚氯乙烯（PVC）管是目前常用的给水塑料管材，若处理不当可带来一定健康危害，其中可能具有致癌性作用的物质是
A. 聚氯乙烯树脂
B. 二氯乙烯
C. 氯乙烯单体
D. 二氯乙烷
E. 聚乙烯

正确答案：C。氯乙烯单体

解析：本题考查可能具有致癌性作用的物质。聚氯乙烯管是目前常用的给水塑料管材，聚氯乙烯树脂本身无毒，但所残留的催化剂及二氯乙烷均有一定毒性。若处理不当可带来一定健康危害，其中可能具有致癌性作用的物质是氯乙烯单体（C对ABDE错）。